生物制品批准文号的格式是
A. 国药准字HJ+4位年号+4位顺序号
B. 国药准字S+4位年号+4位顺序号
C. H+4位年号+4位顺序号
D. 国药准字H+4位年号+4位顺序号

正确答案：B。国药准字S+4位年号+4位顺序号

解析：本题考查的是药品批准文号的格式。生物制品批准文号的格式是国药准字S+4位年号+4位顺序号（B对）。药品注册证书载明的药品批准文号的格式：①境内生产药品：国药准字H（Z、S）+四位年号+四位顺序号（D错）；②中国香港、澳门和台湾地区生产药品：国药准字H（Z、S）C+四位年号+四位顺序号；③境外生产药品：国药准字H（Z、S）J+四位年号+四位顺序号（A错）。其中，H代表化学药，Z代表中药，S代表生物制品。